在一项有500名病例和500名对照的研究中，分别在400名病例和100名对照中发现可疑病因因素。具有该因素的人发生该病的相对危险度是
A. 0.8
B. 0.4
C. 0.16
D. 0.2
E. 由上述资料不能计算

正确答案：E。由上述资料不能计算

解析：本题考查病例对照研究的数据处理。在病例对照研究中一般不能获得发病率和相对危险度（E对ABCD错），但可用比值比（OR）来近似估计相对危险度。